下列各项，医学道德所具有的特点不包括的是
A. 具有全人类性
B. 具有实践性
C. 具有稳定性
D. 具有天然性
E. 具有继承性

正确答案：D。具有天然性

解析：医学道德所具有的特点包括：普世性即具有全人类性（A对）、具有实践性（B对）、具有稳定性（C对）及连续性、具有继承性（E对）。天然性不属于医学道德所具有的特点（D错，为本题正确答案）。